掌深弓的描述，哪项错误
A. 位于指深屈肌腱的浅面
B. 由桡动脉末端和尺动脉掌深支吻合而成
C. 凸侧缘分出3条分支
D. 分支称掌心动脉
E. 掌心动脉与掌侧总动脉吻合

正确答案：A。位于指深屈肌腱的浅面

解析：掌深弓位于指深屈肌腱的深面（A错，为本题正确答案）。由桡动脉末端和尺动脉掌深支吻合而成（B对）。弓的凸侧分出3条分支（C对），分支为三条掌心动脉（D对），掌心动脉与掌侧总动脉吻合（E对）。